在直立位或坐位时最不易引流
A. 额窦
B. 蝶窦
C. 上颌窦
D. 筛窦前、中群
E. 筛窦后群

正确答案：C。上颌窦

解析：上颌窦窦口高于窦底，故窦内积液时直立位不易引流（C对）。